胸剑联合中点至脐中
A. 3寸
B. 5寸
C. 8寸
D. 12寸
E. 16寸

正确答案：C。8寸

解析：根据骨度分寸量表，8寸的有：剑胸结合中点至脐中（胸腹部）、两乳头之间（胸腹部）（C对）。3寸（A错）的有：眉间（印堂）至前发际正中（头面部）、肩胛骨内侧缘至后正中线（背腰部）、内踝尖至足底（下肢部）；5寸（B错）的有：脐中至耻骨联合上缘（曲骨）（胸腹部）；12寸（D错）的有：前发际正中至后发际正中（头面部）、两肩胛骨喙突内侧缘之问（胸腹部）、肘横纹（平尺骨鹰嘴）至腕掌（背）远端横纹（上肢部）；16寸（E错）的有：腘横纹至外踝尖（下肢部）。